久卧病床的患者会有房间或床铺异动感，这属于
A. 感知觉异常
B. 注意异常
C. 记忆异常
D. 定向力异常
E. 思维异常

正确答案：A。感知觉异常

解析：感知觉异常：患病或进入病人角色以后，多数病人的注意力由外部世界转向自身的体验和感受，躯体的主观感受性增高。有的患者会出现时间和空间知觉异常，如住院病人，特别是病程迁延、久治不愈的病人，会有度日如年之感，久病卧床的患者会有房间或床铺异动感等。掌握“患者一般心理问题及不同年龄阶段患者心理”知识点。